下列治疗感冒的中成药中，既含马来酸氯苯那敏又含安乃近的是
A. 维C银翘片
B. 感特灵胶囊
C. 重感灵片
D. 感冒灵胶囊
E. 复方感冒灵片

正确答案：C。重感灵片

解析：本题考查的是含西药组分的中成药。下列治疗感冒的中成药中，既含马来酸氯苯那敏又含安乃近的是重感灵片（C对）。重感灵片：功能解表清热，疏风止痛。用于感冒表邪未解、入里化热所致的恶寒高热、头痛、四肢酸痛、咽痛、鼻塞咳嗽。含西药成分：马来酸氯苯那敏、安乃近。维C银翘片（A错）：功能疏风解表，清热解毒。用于外感风热所致流行性感冒，症见发热、头痛、咳嗽、口干、咽喉疼痛。含西药成分：对乙酰氨基酚、马来酸氯苯那敏、维生素C。感特灵胶囊（B错）：功能清热解毒，清肺止咳。用于感冒初期引起的咳嗽，流清涕、头痛目眩。含西药成分：对乙酰氨基酚、马来酸氯苯那敏、咖啡因。复方感冒灵片（E错）：功能辛凉解表，清热解毒。用于风热感冒及温病之发热、微恶风寒、头身痛、口干渴、鼻塞涕浊、咽喉红肿疼痛、咳嗽、痰黄黏稠。含西药成分：对乙酰氨基酚、马来酸氯苯那敏、咖啡因。感冒灵胶囊（D错）所含西药成分，2022年考试指南未明确说明。感冒灵胶囊：功能解热镇痛。用于感冒初期引起的咳嗽、发热、鼻塞流涕、咽痛等症。含西药成分：对乙酰氨基酚、马来酸氯苯那敏、咖啡因。